男性，45岁，酗酒后8小时出现中上腹疼痛，放射至两侧腰部，伴恶心呕吐。体检腹部有压痛、肌紧张及两侧腰腹部出现蓝棕色斑，血压75/55mmHg，脉搏110次/分，对诊断困难者进一步采取
A. 剖腹探查
B. ERCP检查
C. 抗感染治疗下严密观察
D. 抗休克治疗
E. 腹腔穿刺

正确答案：E。腹腔穿刺

解析：中年男性患者，酗酒后（急性胰腺炎的常见病因）8小时出现中上腹疼痛，放射至两侧腰部，伴恶心、呕吐（急性胰腺炎的典型临床表现）。体查：腹部有压痛、肌紧张（腹膜刺激征），两侧腰腹部出现蓝棕色斑（Grey-Turner征），血压75／55mmHg，脉搏110次/分（坏死性胰腺炎可出现脉速、血压下降，乃至休克）。根据患者的病史及体查，应诊断为急性胰腺炎。对诊断困难者可采取诊断性腹腔穿刺（E对），若抽出血性浑浊液体，其淀粉酶值升高，有助于明确急性胰腺炎的诊断。剖腹探查（A错）为损伤较大的有创性检查，不作首选。ERCP检查（B错）可导致2%～10%病人发生胰腺炎，须慎用。抗感染治疗下严密观察（C错）对明确诊断无意义，且患者目前尚无应用抗生素的指征。抗休克治疗（D错）为一般对症治疗措施，并不能明确诊断。